男性，45岁。右下腹隐痛4个月，近2个月来乏力、消瘦，常有低热，查体：结膜苍白，右侧腹部5cm×3cm肿块。化验：血红蛋白95g/L。若检查诊断为升结肠癌，最佳手术方式是
A. 升结肠切除术
B. 右半结肠切除术
C. 全结肠切除术
D. 升结肠及部分横结肠切除术
E. 升结肠及末段回肠切除术

正确答案：B。右半结肠切除术

解析：中年男性患者，诊断为升结肠癌，最佳手术方式是右半结肠切除术（B对）。结肠癌的手术术式不包括升结肠切除术（A错）。全结肠切除术一般较少见（C错）。升结肠及部分横结肠切除术一般见于结肠癌并发急性梗阻的一期手术（D错）。升结肠及末段回肠切除术于九版外科学教材中未提及（E错）。